男性，68岁，饮酒后不能自行排尿5小时急诊住院，体检见耻骨上包块，有轻压痛。该患者最可能的病因是
A. 前列腺增生
B. 尿道狭窄
C. 膀胱肿瘤
D. 尿道结石
E. 神经性膀胱

正确答案：A。前列腺增生

解析：老年男性患者，饮酒后不能自行排尿，体检见耻骨上包块，有轻压痛，考虑可能为急性尿潴留。患者为老年男性，有饮酒史，故该患者最可能的病因是前列腺增生（A对）。前列腺增生是老年男性排尿障碍原因中最为常见，饮酒可使前列腺突然充血、水肿，使其梗阻症状加重。尿道狭窄（B错）、膀胱肿瘤（C错）所致尿潴留多为慢性。尿道结石（D错）虽也可见急性尿潴留，但在老年男性不如前列腺增生常见。神经性膀胱（E错）指由中枢或周围神经系统病变引起的膀胱功能障碍，多见于脊髓、马尾损伤、肿瘤、糖尿病等。